首选氧氟沙星治疗的是
A. 伤寒
B. 乙脑
C. 流感
D. 流脑
E. 霍乱

正确答案：A。伤寒

解析：伤寒首选氟喹诺酮类，如氧氟沙星等（A对）。流脑治疗首选青霉素（C错）。